根据中国药学会医院药学专业委员会相关标准。将高危药品分为A、B、C三级进行管理。属于A级高危药品的是
A. 10%氯化钾注射液
B. 维库溴铵注射液
C. 5%葡萄糖注射液
D. 华法林片
E. 多潘立酮片

正确答案：A。10%氯化钾注射液

解析：本题考查高危药品分级管理。高危药品是分为A、B、C三个级别，A级是最危险的药品，多见于抢救用药，比如肾上腺素、普奈洛尔、高糖、胰岛素、硫酸镁、氯化钾（A对）以及硝普钠、丙泊酚、地高辛、胺碘酮、浓盐以及阿片类的镇痛剂。第二等级是B级，常见心脑血管疾病用药，如法华林、放射性的静脉造影剂、异丙嗪、秋水仙碱注射液以及化疗药、催产素、中度的镇静药咪达唑仑。C级是较轻微的高危药品，常见口服降糖药、甲氨蝶呤以及肌肉松弛剂、口服的化疗药、腹膜和血液透析液等。